男，45岁，湖北渔民，经常腹痛、腹泻，体力逐渐下降半年，当地有类似患者。查体：体温正常，慢性病容，腹膨隆，脾肋下2cm，移动性浊音（+），血常规：Hb90g/L，WBC2.5×10⁹/L，N0.6，本患者所患疾病的病理特点是
A. 门静脉血栓形成
B. 肝细胞坏死及假小叶形成
C. 肝内门静脉周围纤维化
D. 肝静脉血栓形成
E. 干酪样坏死

正确答案：C。肝内门静脉周围纤维化

解析：患者中年男性，渔民，经常腹痛、腹泻，体力逐渐下降半年，当地有类似患者（可能受水源影响，考虑为寄生虫病）。慢性病容，腹膨隆，脾肋下2cm（肝脾大），移动性浊音（+），血常规：Hb90g/L（正常值120～160g/L，降低提示贫血），WBC2.5×10⁹/L（正常值4～10×10⁹/L，降低提示肝硬化导致脾亢），N0.6（正常值0.4～0.75，在正常范围内），诊断为血吸虫病导致的肝硬化门静脉高压。由于虫卵在肝内主要沉积在门静脉分支附近，纤维化常使门静脉灌注障碍（C对），所导致的肝硬化常以门静脉高压为突出特征。门静脉血栓形成（A错）为肝硬化常见并发症，延伸为肝前性门静脉高压，多表现为小肠坏死，腹膜炎，休克及死亡。肝细胞坏死及假小叶形成（B错）为肝炎性肝硬化的主要病理表现。肝静脉血栓形成（D错）多表现为腹痛，肝脏肿大，下肢水肿及静脉曲张。干酪样坏死（E错）多见于结核。